关于枕先露的分娩机制，正确的是
A. 胎头进入骨盆入口时以枕下前囟径衔接
B. 胎头降至骨盆底时开始俯屈
C. 当胎头在中骨盆开始内旋转
D. 宫缩和腹压促使胎头仰伸
E. 分娩过程中胎头呈持续性下降

正确答案：C。当胎头在中骨盆开始内旋转

解析：枕先露分娩时，胎头以双顶径进入骨盆入口平面，以枕额径进行衔接（A错）。当胎头降至骨盆底时，原处于半俯屈位的胎头枕部遇到肛提肌阻力，借杠杆作用进一步俯屈（B错）。内旋转从中骨盆平面开始（C对）至骨盆出口平面完成。宫缩和腹压使胎头下降（D错），仰伸是宫缩、腹压、肛提肌、耻骨弓共同作用的结果。分娩过程中，要经过衔接→下降→俯屈→内旋转→仰伸→复位及外旋转→胎肩及胎儿娩出等过程，可见胎头并不是持续下降的（E错）。